当人体向周围物体辐射散热量大于人体接受周围物体的辐射热量时称为
A. 正辐射
B. 负辐射
C. 热辐射
D. 强辐射
E. 弱辐射

正确答案：B。负辐射

解析：本题考查负辐射。当人体向周围物体辐射散热量大于人体接受周围物体的辐射热量时称为负辐射（B对DE错）。当物体表面温度超过人体表面温度时，物体向人体传递热辐射而使人体受热称为正辐射（A错）。热辐射（C错）是物体由于具有温度而辐射电磁波的现象。